加入AlCl3／HCl后，某黄酮的峰带Ⅰ（300-400nm）红移60nm，这表明结构中含有
A. 5-OH
B. 7-OH
C. 3’-0H
D. 3-0H
E. 4’-0H

正确答案：D。3-0H